药物过敏性口炎临床诊断依据是
A. 发病前的用药史、口腔黏膜明显充血、水肿、可出现红斑水疱
B. 发病前的用药史、病损区黏膜出现珠光白色网纹伴充血
C. 发病前的用药史、口腔黏膜病损为突然发生的急性炎症、停用可疑致敏药物后，病损很快消退
D. 起病急，口腔黏膜明显充血、水肿，可出现糜烂和溃疡
E. 起病急，口腔黏膜出现红斑、水泡

正确答案：C。发病前的用药史、口腔黏膜病损为突然发生的急性炎症、停用可疑致敏药物后，病损很快消退

解析：本题考查药物过敏性口炎的诊断。诊断依据：①有明确的用药史或曾有药物过敏史；②突然发生的急性炎症，口腔黏膜起疱，疱破溃形成糜烂面，边缘多比较整齐。皮肤有红斑、疱疹及丘疹等病变；③停用可疑致敏药物后，病损很快愈合。